男，50岁。车祸2小时急诊入院，经抢救后生命体征平稳，神志清醒。现出现下腹部疼痛，不能排尿4小时。查体：下腹部叩诊呈浊音，直肠指检可触及直肠前方饱满，前列腺尖端浮动感。X线摄片显示骨盆骨折（耻骨下支断裂）。后期需要补充的最重要的检查是
A. B超
B. 尿道造影
C. CT
D. 膀胱造影
E. 静脉尿路造影

正确答案：B。尿道造影

解析：逆行尿道造影（B对）是确定尿道损伤的主要方法（七版黄家驷外科学P2314）；B超（A错）、CT（C错）和静脉尿路造影（E错）多用于肾输尿管损伤诊断；膀胱造影（D错）多用于膀胱损伤诊断。